只限于医疗、教学和科研需要，其他一律不得使用的药品是
A. 医用毒性药品
B. 精神药品
C. 放射性药品
D. 麻醉药品
E. 血液制品

正确答案：D。麻醉药品

解析：本题考查麻醉药品。只限于医疗、教学和科研需要，其他一律不得使用的药品是麻醉药品（D对）。药品经营企业不得经营麻醉药品原料药和第一类精神药品原料药。但是，供医疗、科学研究、教学使用的小包装的上述药品可以由国务院药品监督管理部门规定的药品批发企业经营。